淋巴干中无
A. 左、右颈干
B. 左、右锁骨下干
C. 左、右肠干
D. 左、右支气管纵隔干
E. 左、右腰干

正确答案：C。左、右肠干

解析：淋巴干有九条，分别是：左右颈干，左右锁骨下干，左右支气管纵隔干，左右腰干和一条肠干，肠干仅有一条（C错）。